下列有关铸造的圈形卡环描述，说法不正确的是
A. 多用于远中孤立的磨牙
B. 有颊、舌侧两个支托
C. 远中支托有增加支持的作用
D. 远中支托有防止基牙进一步倾斜移位作用
E. 非倒凹一侧卡环臂有辅助臂与支架相连，可增加卡环臂的强度

正确答案：B。有颊、舌侧两个支托

解析：铸造的圈形卡多用于远中孤立的磨牙上，有近、远中两个支托。远中支托有增加支持，防止基牙进一步倾斜移位作用。非倒凹一侧卡环臂有辅助臂与支架相连，可增加卡环臂的强度。掌握“局部义齿固位体”知识点。